松动牙固定适用于
A. 任何松动牙
B. 在牙周治疗前有松动的牙
C. 在牙周治疗后仍有松动的牙
D. 在牙周治疗后仅有咀嚼不适的牙
E. 在牙周治疗后有咀嚼不适和（或）牙松动度继续加重的牙

正确答案：E。在牙周治疗后有咀嚼不适和（或）牙松动度继续加重的牙

解析：本题考查松牙固定的指征和时机。松动牙固定适用于在牙周治疗后有咀嚼不适和（或）牙松动度继续加重的牙（E对）。经过基础治疗后，有咀嚼不适且牙松动加重则应该进行松牙固定术。任何松动的牙都应根据病因进行治疗，如果为牙周炎引起的牙齿松动，则应在牙周基础治疗后再进行松牙固定（AB错）。在牙周治疗后仍有松动的牙，松动度不大不影响咬合不需要固定（C错）。仅有咀嚼不适，牙松动度小，可通过调（牙合）减轻，不需要固定（D错）。